5岁男孩，颜面四肢浮肿2月，血压120/80mmHg，查尿常规：蛋白（+++），红细胞15个/HP，血总蛋白40g/L，白蛋白25g/L。该患儿最可能的诊断是
A. 急性肾炎
B. 慢性肾炎
C. 单纯性肾病综合征
D. 肾炎性肾病综合征
E. 急进性肾炎

正确答案：D。肾炎性肾病综合征

解析：患儿大量蛋白尿（+++）、低蛋白血症（白蛋白＜30g/L）、水肿，应诊断为肾病综合症。单纯型肾病仅表现为“三多一少”的典型症状，即大量蛋白尿、低蛋白血症、高胆固醇血症、水肿。而本例有血尿（RBC15个/HP）、高血压（120/80mmHg），因此不能诊断为单纯性肾病综合症，而应诊断为肾炎性肾病综合征（D对C错）。急性肾炎不会出现大量蛋白尿及低蛋白血症（A错）。本例病程仅2个月，不能诊断为慢性肾炎（B错）。急进性肾炎常表现为短期内肾功能急剧减退，试题题干未述及肾功能，故本例不能诊断为急进性肾炎（E错）。